患者，女，48岁。烦躁失眠一年余，容易受惊，口苦泛恶，胸胁胀满，舌红苔黄腻，脉滑数此属
A. 心肾不交
B. 心脾两虚
C. 胆郁痰扰
D. 肝火炽盛
E. 心火上炎

正确答案：C。胆郁痰扰

解析：患者痰热内扰，胆气不宁，失于决断，故惊悸失眠，胆怯易惊，烦躁不安；胆热犯胃，气逆于上，则口苦呕恶；胆失疏泄，气机不利，则胸胁闷胀；舌红苔黄腻，脉弦数，为痰热内盛之证（C对）。心肾不交以心烦、失眠梦遗、耳鸣、腰膝酸软等为主要表现（A错）。心脾两虚以心悸怔忡、失眠多梦、食少、腹胀、便溏及气血两虚症状为主要表现（B错）。肝火炽盛证证候表现为头目胀痛，眩晕，面红目赤，口苦口干，急躁易怒，失眠多梦，耳鸣耳聋，或耳痛流脓，或胁肋灼痛，或吐血、衄血，大便秘结，小便短黄，舌红苔黄，脉弦数（D错）。心火上炎症见口舌生疮，口腔糜烂，心烦失眠，舌尖红绛等（E错）。